男，1岁。突然哭闹4小时，阵发性发作，不发作时如正常，发作时面色苍白伴呕吐，为所食牛奶，大便呈果酱样。发作时查体，最可能的腹部体征是
A. 全腹胀，可见肠型
B. 肝浊音界消失
C. 肠鸣音减弱或消失
D. 右腹部可扪及腊肠形肿物
E. 全腹肌紧张

正确答案：D。右腹部可扪及腊肠形肿物

解析：患儿有果酱便、哭闹、呕吐的临床表现，应诊断为肠套叠，肠套叠腹部体征为右腹部可扪及腊肠形肿物（D对）。全腹胀，可见肠型是肠梗阻的腹部体征（A错）。肝浊音界消失是空腔脏器穿孔的体征（B错）。肠鸣音减弱或消失常见于动力性肠梗阻（C错）。全腹肌紧张见于腹膜炎或空腔脏器穿孔（E错）。